牛蒡子的功效是
A. 息风止痉
B. 平肝明目
C. 消肿疗疮
D. 凉血止血
E. 升阳止泻

正确答案：C。消肿疗疮

解析：本题考查的是辛凉解表药牛蒡子的功效。牛蒡子的功效是消肿疗疮（C对）。牛蒡子：【功效】疏散风热，宣肺利咽，解毒透疹，消肿疗疮。蝉蜕：【功效】疏散风热，透疹止痒，明目退翳，息风止痉（A错）。桑叶：【功效】疏散风热，清肺润燥，平肝明目（B错），凉血止血（D错）。葛根：【功效】解肌退热，透疹，生津，升阳止泻（E错）。